急性肢体动脉栓塞的临床表现“5p”，不包括
A. 疼痛
B. 感觉异常
C. 麻痹
D. 脉快
E. 苍白

正确答案：D。脉快

解析：动脉栓塞是指动脉腔被进入血管内的栓子堵塞（血栓、空气、脂肪、癌栓及其他异物），造成血流阻塞，引起急性缺血的临床表现，可概括为“5P”征，包括疼痛（A对）、感觉异常（B对）、麻痹（C对）、苍白（E对）和无脉（D错，为本题正确答案）。